肾是泌尿系统功能的主要执行者。位于腹膜后，其周围有被膜保护，具有产生尿液及重要的内分泌功能。对肾位置的描述，错误的是
A. 右肾上端平第12胸椎上缘
B. 右肾下端平第3腰椎上缘
C. 属于腹膜内位器官
D. 左肾比右肾高
E. 位于腹膜后脊柱两侧

正确答案：C。属于腹膜内位器官

解析：肾位于腹膜后脊柱两侧（E对），为腹膜外位器官（C错，为本题正确答案）。因受肝的挤压，右肾低于左肾（D对）。右肾上端平第12胸椎上缘（A对），下端平第3腰椎上缘（B对）。